诊断肾结核，最可靠的依据是
A. IVU
B. 尿结核杆菌培养阳性
C. 尿中找到抗酸杆菌
D. 尿常规检查呈酸性脓尿
E. 尿频、尿急、尿痛

正确答案：B。尿结核杆菌培养阳性

解析：尿结核杆菌培养阳性对于诊断肾结核有决定性意义（B对）。IVU见肾盏有破坏性改变是诊断肾结核最有价值的影像学检查，不是最可靠的诊断依据（A错）。尿中找到抗酸杆菌，不应作为诊断肾结核的唯一依据，因包皮垢杆菌、枯草杆菌也是抗酸杆菌，易和结核分支杆菌混淆（P546）（C错）。尿常规检查呈酸性脓尿是肾结核的常见症状，但是还需除外其他泌尿系统化脓性感染疾病（D错）。尿频、尿急、尿痛（即膀胱刺激症状）见于非特异性膀胱炎、结核性膀胱炎等，不是诊断肾结核的可靠依据（P547）（E错）。